《医疗事故处理条例》共
A. 61条
B. 62条
C. 63条
D. 64条
E. 65条

正确答案：C。63条

解析：《医疗事故处理条例》有总则、医疗事故的预防与处置、医疗事故的技术鉴定、医疗事故的行政处理与监督、医疗事故的赔偿、罚则、附则7章，共63条。掌握“医疗事故处理概述、预防与处置”知识点。